男，65岁。大量呕血黑便1天。既往有胃溃疡病史20年，曾有多次出血史。查体：P126次/分，BP86/50mmHg。神情紧张，烦躁，手足湿冷，股软，上腹部压痛（+），肠鸣音亢进。血常规：Hb90g/L，血细胞比容0.30。心电图示窦性心动过速。对该患者目前首选的重要治疗措施是
A. 输注浓缩红细胞
B. 立即静注止血药物
C. 立即静滴垂体后叶素
D. 冰盐水200ml+去甲肾上腺素8mg胃内灌注
E. 快速静滴平衡盐溶液

正确答案：E。快速静滴平衡盐溶液

解析：老年男性患者，大量呕血、黑便1天，P126次／分（正常为60～100次／分），BP86/50mmHg（正常为90～139/60～89mmHg），Hb90g/L（正常男性为120～160g/L），血细胞比容0.30（温氏法测得正常男性为0.40～0.50，脉快、血压下降、血红蛋白及血细胞比容下降提示失血），既往胃溃疡病史20年，结合患者病史、体查和相关检查，应诊断为胃溃疡大出血。患者失血症状较重，为防治休克，目前首选的治疗措施是快速静滴平衡盐溶液以扩充血容量（E对）。输注浓缩红细胞（A错）可提高血细胞比容，但短期内不能迅速改善失血症状，一般对于Hb＜70g/L的患者可考虑输注浓缩红细胞；静注止血药物（B错）、静滴垂体后叶素（C错）、冰盐水200ml+去甲肾上腺素8mg胃内灌注（D错）等有助于控制出血，但均为一般性治疗措施。